男性，40岁。诉左下后牙反复肿胀、咀嚼无力。口腔检查：左下6牙合面深龋，穿通髓腔，探诊（-），叩诊（±），颊侧有深牙周袋，溢脓，松动I°，X线片示：根尖区阴影显“烧瓶状”。温度试验（-）。初步诊断
A. 牙周牙髓联合症中的牙周病与牙髓病并存
B. 牙周牙髓联合症中的牙周病引起牙髓坏死
C. 逆行性牙髓炎
D. 牙周牙髓联合症中的急性根尖周脓肿反复发作引起的牙周破坏
E. 以上均是

正确答案：D。牙周牙髓联合症中的急性根尖周脓肿反复发作引起的牙周破坏

解析：本题考查牙周-牙髓联合病变的临床类型。牙槽脓肿反复发作且长期从牙周排脓而未得到彻底治疗者，因病情反复发作，临床表现为深牙周袋出血溢脓、牙槽骨吸收、牙松动，相应处黏膜可有瘘管、叩诊不适等，典型病例的X线片表现为根尖区阴影与牙槽嵴的吸收相连，形成所谓的烧瓶形或日晕圈状病变，据此可判断患者的临床表现符合牙周牙髓联合症中的急性根尖周脓肿反复发作引起的牙周破坏（D对）的病变特点。牙周牙髓联合症中的牙周病与牙髓病并存（A错）是指发生于同一个牙齿上各自独立的牙髓和牙周病变，当病变发展到严重阶段时，二者可相互融合和影响。牙周牙髓联合症中的牙周病引起牙髓坏死（B错）无X线片烧瓶状根尖阴影区。逆行性牙髓炎（C错）临床检查时可见患牙有深牙周袋或严重的牙龈退缩，牙齿一般松动达Ⅱ度以上，牙髓有明显的激发痛。